以5岁或10岁为一个年龄组而编制的寿命表称为
A. 寿命表
B. 定群寿命表
C. 现时寿命表
D. 完全寿命表
E. 简略寿命表

正确答案：E。简略寿命表

解析：本题考查简略寿命表的编制。简略寿命表（E对ABCD错）的编制是根据某一人群的年龄组死亡率计算的一种统计图表，其一般以5岁为1个年龄组进行编制。